有关网膜孔的叙述，下列哪项是错的
A. 其前方是肝十二指肠韧带
B. 后界是肝门静脉
C. 其上界为尾状叶
D. 其下界为十二指肠球部
E. 是大腹膜腔通入网膜囊的唯一孔道

正确答案：B。后界是肝门静脉

解析：网膜孔前方为肝十二指肠韧带(A对)，后界为覆盖在下腔静脉表面的腹膜(B错，为本题正确答案)，上界为肝尾状叶(C对)，下界为十二指肠上部又叫十二指肠球(D对)，网膜孔为大腹膜腔通入网膜囊的唯一的通道(E对)。